《药品经营质量管理规范》规定应具有药学专业技术职称的是
A. 药品零售企业主要负责人
B. 药品零售企业专职质量管理人员
C. 药品零售企业中处方审核人员
D. 药品零售企业质量负责人
E. 药品零售企业法定代表人

正确答案：D。药品零售企业质量负责人

解析：本题考查质量负责人。《药品经营质量管理规范》规定应具有药学专业技术职称的是药品零售企业质量负责人（D对）。质量管理、验收、采购人员应当具有药学或者医学、生物、化学等相关专业学历或者具有药学专业技术职称。从事中药饮片质量管理、验收、采购人员应当具有中药学中专以上学历或者具有中药学专业初级以上专业技术职称。